三条或三条以上的发育沟相交所形成的凹陷称为
A. 窝
B. 点隙
C. 外展隙
D. 楔状隙
E. 邻间隙

正确答案：B。点隙

解析：本题考查点隙。三条或三条以上的发育沟相交所形成的凹陷称为点隙（B对）。点隙是三条或三条以上发育沟的汇合处所形成的点状凹陷，该处的牙釉质若钙化不全，则成为点隙裂。窝是牙冠舌面及（牙合）面上不规则的凹陷（A错）。外展隙（C错）又叫楔状隙（D错），和邻间隙（E错）均是牙周围的空隙，不是发育沟形成的凹陷。